可产生下一代阴道癌的是
A. 普萘洛尔
B. 庆大霉素
C. 异丙肾上腺素
D. 林可霉素
E. 己烯雌酚

正确答案：E。己烯雌酚